下列固定桥中哪一类属于特殊结构固定桥
A. 双端固定桥
B. 单端固定桥
C. 半固定桥
D. 复合固定桥
E. 种植基牙固定桥

正确答案：E。种植基牙固定桥

解析：本题考查固定局部义齿的类型。种植基牙固定桥（E对）属于特殊结构固定桥，其基牙为种植体而不是基本的天然牙。固定局部义齿按其结构分为三种基本类型：双端固定桥（A错）、单端固定桥（B错）、半固定桥（C错）。以上两种或三种的组合又称为复合固定桥（D错），也属于固定桥的基本类型。